男，35岁。车祸致腰背部受伤，腰部活动明显受限，双下肢出现迟缓性瘫痪，大小便失禁。伤后1小时双下肢感觉、运动功能好转。最可能的诊断是
A. 马尾神经损伤
B. 脊髓挫伤
C. 脊髄受压
D. 脊髓震荡
E. 脊髓出血

正确答案：D。脊髓震荡

解析：患者腰背部外伤后，立即出现双下肢弛缓性瘫痪、大小便失禁（提示可能有脊髓损伤），伤后1小时恢复正常，结合患者病史和临床表现，该患者最可能的诊断为脊髓震荡（D对）。脊髓出血（E错）所致的感觉运动损伤通常是永久性的。脊髓挫伤（B错）可致脊髓水肿、出血，表现为脊髓平面以下的各种功能障碍、截瘫或不完全截瘫，持续时间较长，不会在短期内恢复正常。脊髓受压（C错）多见于有移位的脊柱骨折，脊髓由于受到碎骨片压迫而导致瘫痪，移去压迫物脊髓功能可恢复正常，但压迫时间过长，脊髓会发生坏死、软化、萎缩或瘢痕形成，则瘫痪难以恢复。马尾神经损伤（A错）主要表现为损伤平面以下弛缓性瘫痪，且一般为不可逆性，不会在短期内恢复正常。